连翘败毒丸（天津方）的注意事项有
A. 丹毒慎用
B. 孕妇忌用
C. 疮疡阴证慎用
D. 年老体弱者慎用
E. 不宜与寒凉性药物同用

正确答案：B、C、D。孕妇忌用；疮疡阴证慎用；年老体弱者慎用

解析：本题考查的是连翘败毒丸的注意事项。连翘败毒丸（天津方）的注意事项有孕妇忌用（B对）、疮疡阴证慎用（C对）、年老体弱者慎用（D对）。连翘败毒丸【注意事项】孕妇忌用、疮疡阴证慎用、年老体弱者慎用。高血压、心脏病患者慎用。